细胞周期非特异性药物，主要包括
A. 细胞毒素类、抗生素类
B. 抗生素类、抗代谢类
C. 抗代谢类、植物类
D. 抗生素类、激素类
E. 细胞毒素类、植物类

正确答案：A。细胞毒素类、抗生素类

解析：细胞周期非特异性药物：药物可作用于细胞增殖周期的各期。对肿瘤和正常细胞选择性小，对增殖细胞和非增殖细胞作用相似，对癌细胞和正常造血细胞有相似的毒性。这类药物主要是通过抑制脱氧核糖核酸的复制和影响脱氧核糖核酸的功能而发挥作用，但亦包括一些抑制核糖核酸和蛋白质合成的药物。主要为一些细胞毒素类和抗生素类药物。掌握“口腔颌面部肿瘤的治疗原则及预防”知识点。